十五元环的大环内酯类抗生素为
A. 罗红霉素
B. 克拉霉素
C. 琥乙红霉素
D. 阿奇霉素
E. 红霉素

正确答案：D。阿奇霉素

解析：本题考查大环内脂类抗菌药物。阿奇霉素（D对）在红霉素结构上修饰后得到的一种广谱抗生素，属于第二代十五元环的大环内酯类抗生素。罗红霉素（A错）、克拉霉素（B错）、琥乙红霉素（C错）、红霉素（E错）均属于十四元环的大环内酯类抗生素。